《中国药典》一部规定测定斑蝥中斑蝥素的含量用
A. 气相色谱法
B. 高效液相色谱法
C. 薄层扫描法
D. 分光光度法
E. 酸碱滴定法

正确答案：A。气相色谱法